交感神经兴奋时
A. 膀胱松驰
B. 膀胱肌收缩
C. 尿道内括约肌松驰
D. 输尿管收缩
E. 排尿

正确答案：A。膀胱松驰

解析：交感神经兴奋时消化活动受抑制，导致尿量减少，膀胱松驰（A对）。